突发公共卫生事件不具有的特点是
A. 突发性
B. 群体性
C. 时效性
D. 危害性
E. 不确定性

正确答案：C。时效性

解析：本题考查公共卫生工作伦理要求。时效性（C错，为本题正确答案）是指信息仅在一定时间段内对决策具有价值的属性。与突发公共卫生事件无关，属于干扰选项。一般说来，突发公共卫生事件是突然发生的（A对），具有很强的不确定性（E对）；其次，突发公共卫生事件的发生呈现群体性（B对），目标对象往往是不特定的社会群体；再次，突发公共卫生事件可能导致全国性或全球性的公共卫生危机；最后，突发公共卫生事件不但会对公众健康造成严重损害，严重时还会影响社会安定，破坏社会正常秩序，具有危害性（D对）。